布麻叶的原植物属于
A. 夹竹桃科
B. 十字花科
C. 五加科
D. 毛茛科
E. 唇形科

正确答案：A。夹竹桃科